作用于酪氨酸激酶受体通路的抗肿瘤药物是
A. 磺胺甲噁唑
B. 来曲唑
C. 奥司他韦
D. 左氧氟沙星
E. 甲磺酸伊马替尼

正确答案：E。甲磺酸伊马替尼

解析：本题考查作用于酪氨酸激酶受体通路的抗肿瘤药物。甲磺酸伊马替尼（E对）是第一个上市的酪氨酸激酶抑制剂，其在体内外均可在细胞水平上抑制“费城染色体”的Bcr-Ahl酪氨酸激酶，能选择性抑制Bcr-Ahl阳性细胞系细胞、Ph染色体阳性的慢性粒细胞白血病和急性淋巴细胞白血病病人的新鲜细胞的增殖和诱导其凋亡。磺胺甲噁唑（A错）为磺胺类抗菌药。来曲唑（B错）是一种选择性的、非甾体类的芳香化酶抑制剂，可通过抑制芳香化酶，使雌激素水平下降，从而消除雌激素对肿瘤生长的刺激作用，用于乳腺癌化疗和放疗。奥司他韦（C错）为抗病毒药。左氧氟沙星（D错）为喹诺酮类抗菌药。